国家发展和改革委员会
A. 确定使用国家基本药物目录外药品品种数量
B. 制定国家基本药物药品标准
C. 审核国家基本药物目录
D. 制定国家基本药物全国零售指导价
E. 确定配备使用国家基本药物目录的民族药

正确答案：D。制定国家基本药物全国零售指导价

解析：本题考查国家发展和改革委员会职责。国家发展和改革委员会负责制定国家基本药物全国零售指导价（D对）。